依据糖尿病诊断标准，确诊糖尿病选用
A. 全血血糖
B. 血浆血糖
C. 糖化血红蛋白
D. 尿糖定性
E. 24小时尿糖定量

正确答案：B。血浆血糖

解析：糖尿病是一组由多病因引起的以慢性高血糖为特征的代谢性疾病（P725），因此血糖升高是诊断糖尿病的主要依据，测定血糖可抽静脉血或取毛细血管血，可用血浆、血清或全血，但诊断糖尿病时必须用静脉血浆测定血糖（B对），静脉血浆血糖测定较全血血糖（A错）准确，不受血细胞比容等影响，如血细胞比容正常，血浆血糖比全血血糖高15%。糖化血红蛋可白（C错）无法反映瞬时血糖，主要反映近8～12周总的血糖水平，为糖尿病控制情况的主要监测指标之一（P732），其测定受检测方法、有否贫血和血红蛋白异常疾病、红细胞转换速度、年龄等多种因素影响（P732），我国尚不推荐采用糖化血红蛋白诊断糖尿病。尿糖阳性（DE错）仅提示血糖值超过肾糖阈，无法肯定糖尿病的诊断，尿糖阴性亦不能排除糖尿病可能。